前囟闭合过早见于
A. 头小畸形
B. 佝偻病
C. 甲状腺功能减退
D. 克汀病
E. 脑积水

正确答案：A。头小畸形

解析：前囟出生时约1.0～2.0cm，1～2岁时闭合。前囟闭合过早见于头小畸形，闭合过迟见于佝偻病、甲状腺功能减退和脑积水等。掌握“骨骼发育”知识点。